急性动脉粥样硬化性血栓栓塞性脑梗死的治疗不包括
A. 血浆置换
B. 抗血小板治疗
C. 他汀类药物治疗
D. 溶栓治疗
E. 康复治疗

正确答案：A。血浆置换

解析：急性动脉粥样硬化性血栓栓塞性脑梗死，脑缺血最主要的恢复血流，措施是静脉溶栓（D对），rtPA和尿激酶是我国目前使用的主要溶栓药。未行溶栓的急性脑梗死患者应在48小时之内尽早服用阿司匹林（B对），但在阿司匹林过敏或不能使用时，可用氯吡格雷替代。他汀类药物（C对）属于脑保护剂，可通过降低脑代谢、干预缺血引发细胞毒性机制减轻缺血性脑损伤。应制定短期和长期康复治疗（E对）计划，分阶段、因地制宜地选择治疗方法。血浆置换（A错，为本题正确答案）属于免疫治疗。